溴隐亭的药理作用是
A. 激动中枢阿片受体
B. 抑制中枢神经系统胆碱酯酶
C. 抑制纹状体单胺氧化酶
D. 阻断中枢神经系统胆碱受体
E. 激动黑质纹状体通路多巴胺受体

正确答案：E。激动黑质纹状体通路多巴胺受体

解析：本题考查溴隐亭的药理作用。溴隐亭是一种半合成的麦角生物碱。口服大剂量可激动黑质纹状体通路多巴胺受体（E对），其疗效与左旋多巴相似。小剂量激动结节漏斗部的多巴胺受体，因此可减少催乳素和生长激素的释放。用于回乳、治疗催乳素分泌过多症和肢端肥大症等。